某地为了解新研制的流感气雾免疫制剂的效果，在本地随机确定5000人接种疫苗，另外5000人不接种该疫苗作为对照，经过一个流行期后，前者50人发病，后者500人发病。该疫苗的效果指数为
A. 0.1
B. 10
C. 0.027
D. 0.9
E. 以上都不对

正确答案：B。10